男性，45岁，外伤致骨盆骨折、会阴部撕裂伤，术后尿潴留，烦躁不安，最佳处理方法是
A. 肌注安定10毫克
B. 下腹部热敷
C. 口服止痛药
D. 静注氨甲酰甲胆碱
E. 留置导尿管

正确答案：E。留置导尿管